经常使用化妆品的油性皮肤者常发生
A. 光变应性皮炎
B. 刺激性接触性皮炎
C. 变应性接触性皮炎
D. 化妆品痤疮
E. 色素沉着症

正确答案：D。化妆品痤疮